USP（23）正文部分未收载的内容是
A. 鉴别
B. 含量测定
C. 杂质检查
D. 用法与剂量
E. 包装与贮藏

正确答案：D。用法与剂量

解析：本题考查药典。USP（23）正文部分未收载的内容是用法与剂量（D错，为本题正确答案）。USP为美国药典简称，其基本内容包括凡例、通则和标准正文。正文收载药物的法定名称（英文名称）、结构式、分子式、分子量、化学名、CA登记号、成分和含量限度、鉴别（A对）、含量测定（B对）、检查（C对），以及包装与贮藏（E对）、USP参考标准物质等辅助信息。